女性，25岁。产后第4天出现寒战，高热，腰痛，尿频，尿痛，肾区叩击痛，尿白细胞25/HP，血白细胞18×10⁹/L。考虑此患者产后并发
A. 败血症
B. 产褥热
C. 急性膀胱炎
D. 急性肾盂肾炎
E. 急性肾炎

正确答案：D。急性肾盂肾炎

解析：急性肾盂肾炎（D对）是细菌侵犯肾盂、肾盏及肾实质所引起的急性化脓性炎症。全身感染症状多为急性起病，常有寒战、高热，体温达39℃以上，伴有头痛、全身痛以及恶心、呕吐，甚至腹胀、腹痛、腹泻等临床表现。热型类似脓毒症，大汗淋漓后体温下降，以后又可上升，持续1周左右。泌尿系统表现：多有尿频、尿急、尿痛等尿路刺激症状，每次尿量少，有尿道烧灼感，尿液外观混浊，可见脓尿或血尿。大多伴腰痛或肾区不适。肾区有压痛或叩击痛，腹部上输尿管点、中输尿管点和耻骨上膀胱区有压痛。患者产后4天发病，为急性起病，出现寒战高热等全身症状及腰痛尿频尿痛等泌尿系症状，血、尿常规支持本病诊断。败血症（A错）是指致病细菌侵入血液循环中生长繁殖引起的急性全身性感染，临床症状为寒战、高热、皮疹、关节痛及肝脾肿大，部分患者还可出现烦躁、四肢厥冷及紫绀、脉细速、呼吸等临床表现。产褥热（B错），即"产后发热"，是指产褥期内，出现发热持续不退，或突然高热寒战，并伴有其他症状者。急性膀胱炎（C错）有尿路刺激征，起病突然，有明显尿频、尿急、尿痛，膀胱、尿道痉挛，严重时类似尿失禁，常不能离开便器，难以忍受。排尿期尿道烧灼感，排尿终末期疼痛加剧，会阴部、耻骨上区疼痛、膀胱区轻压痛。病情严重者可并发急性前列腺炎，但一般全身症状不明显。且单纯性膀胱炎，炎症局限于黏膜层，常无发热，白细胞不增高，亦不伴有全身症状。急性肾炎（E错）为急性肾小球肾炎，临床表现为急性起病，以血尿、蛋白尿、高血压、水肿、少尿及氮质血症为主要表现。